非甾体抗炎药罗非昔布所致的不良反应为
A. 成年后易发阴道癌
B. 心脏毒性
C. 皮肤反应
D. 心血管反应
E. 周围神经炎

正确答案：D。心血管反应

解析：本题考查药物不良反应。罗非昔布的不良反应包括：1.血液系统：贫血。2.心血管系统（D对）：高血压。3.中枢神经系统：眩晕。4.消化系统：恶心、腹泻等。